膀胱肿瘤T1期表明肿瘤侵及
A. 粘膜表面
B. 粘膜固有层
C. 浅肌层
D. 深肌层
E. 外膜层

正确答案：B。粘膜固有层

解析：TNM分期标准根据癌浸润膀胱壁的深度（乳头状瘤除外），可分为：Tis原位癌；Ta无浸润的乳头状癌；T1浸润黏膜固有层；T2浸润肌层，又分为T2a浸润浅肌层（肌层内1/2）（C错），T2b浸润深肌层（肌层外1/2）（D错）。故膀胱肿瘤T1期表明肿瘤侵及黏膜固有层（B对）。